缺血－再灌注损伤最严重的后果是
A. 心泵功能衰竭
B. 脑功能障碍
C. 肺功能衰竭
D. 肾功能衰竭
E. 多器官功能障碍综合症

正确答案：E。多器官功能障碍综合症

解析：缺血－再灌注损伤是机体缺血后恢复血液灌流时发生的现象，主要表现为再灌注组织器官的功能代谢障碍及结构损伤。缺血－再灌注损伤会造成心泵功能衰竭（A错）、脑功能障碍（B错）、肺功能衰竭（C错）和肾功能衰竭（D错），但最严重的后果是多器官功能障碍综合症（E对）。